下列关于肺部X线检查临床应用的叙述，错误的是
A. 诊断呼吸系统疾病
B. 检测呼吸功能
C. 防癌
D. 防痨
E. 防职业病

正确答案：B。检测呼吸功能

解析：X线检查是应用人体的自然对比进行透视或摄影的检查，肺部X线检查临床应用包括：①诊断呼吸系统疾病（A对）如肺脓肿、大叶性肺炎等。②防癌（C对）如用于肺癌的筛查。③防痨（D对）如用于肺结核的筛查。④防职业病（E对）如硅肺等。检测呼吸功能呼吸功能的项目主要为肺容积、通气、换气和呼吸动力等项目，X线检查一般无法衡量呼吸功能（B错，为本题正确答案）。